下列关于生存概率和生存率的叙述，正确的是
A. 二者均随时间增加而增大
B. 二者均随时间增加而减小
C. 生存概率是生存率的累积
D. 生存率是生存概率的累积
E. 生存概率一定小于生存率

正确答案：D。生存率是生存概率的累积